女，16岁。大学二年级学生。1年前和同学争吵后，便觉的同学都在议论她，常不怀好意地盯着她，甚至觉得有人跟踪她，想杀她。整天不敢出门，在屋里自言自语。该患者的诊断最恰当的是
A. 癔症
B. 精神分裂
C. 急性惊恐发作
D. 强迫症
E. 躁狂症

正确答案：B。精神分裂

解析：16岁学生，1年前和同学争吵后，便觉的同学都在议论她，常不怀好意地盯着她，甚至觉得有人跟踪她，想杀她（被害妄想是精神分裂症的常见临床阳性症状）。整天不敢出门，在屋里自言自语（出现幻觉是精神分裂症的常见临床阳性症状），综上考虑诊断为精神分裂（B对）。癔症（A错）的主要表现有分离症状和转换症状两种。分离，是指对过去经历与当今环境和自我身份的认知完全或部分不相符合。转换，是指精神刺激引起的情绪反应，接着出现躯体症状，一旦躯体症状出现，情绪反应便褪色或消失。急性惊恐发作（C错）指患者突然发生强烈不适，可有胸闷、气透不过来的感觉、心悸、出汗、胃不适、颤抖、手足发麻、濒死感、要发疯感或失去控制感，每次发作约一刻钟左右。强迫症（D错）的特点为有意识的强迫和反强迫并存，一些毫无意义、甚至违背自己意愿的想法或冲动反反复复侵入患者的日常生活。患者虽体验到这些想法或冲动是来源于自身，极力抵抗，但始终无法控制。躁狂症（E错）以情感高涨或易激惹为主要临床相，伴随精力旺盛、言语增多、活动增多，严重时伴有幻觉、妄想、紧张症状等精神病性症状。